属于急性有机磷农药中毒烟碱样症状的是
A. 瞳孔缩小
B. 语言障碍
C. 支气管痉挛
D. 肌束震颤
E. 多汗、流涎

正确答案：D。肌束震颤